虚风内动可见
A. 眩晕欲仆
B. 目睛上吊
C. 手足蠕动
D. 手足拘挛
E. 角弓反张

正确答案：C。手足蠕动

解析：阴虚动风证证候表现为手足震颤或蠕动，眩晕耳鸣，两目干涩，视物模糊，五心烦热，潮热盗汗，舌红少苔，脉弦细数。阴虚筋脉失养，则见手足蠕动（C对）。眩晕欲仆（A错）见于肝阳化风证，是由肝阳亢逆，气血上冲所致。目睛上吊（B错）多见于惊风、厥阴风痰闭阻或神衰精脱之危证。手足拘挛（D错）指手足筋肉挛急不舒，屈伸不利，多因寒邪凝滞或气血亏虚，筋脉失养所致。角弓反张（E错）指患者脊背后弯，反折如弓，常兼颈项强直，四肢抽搐，为肝风内动，筋脉拘急之象，可见于热极生风之惊风、破伤风、马钱子中毒等病人。